某患者安于已适应的角色，小病大养，而不愿意出院，此时患者的状态被称为患者的角色行为
A. 冲突
B. 减退
C. 缺如
D. 异常
E. 强化

正确答案：E。强化

解析：本题考查病人心理。一位女学生，被诊断为抑郁症，病好了以后，依然安于已适应的角色，该出院而不愿意出院，此时病人的状态被称为角色行为强化（E对）。角色强化：随着躯体的康复，病人角色行为也应转化为正常的社会角色行为。如果这种转化发生阻碍，个体安于病人角色的现状，角色的行为与其疾病症状程度不吻合，对自我过度表示怀疑和忧虑，行为上表现出较强的退缩和依赖性。角色行为减退（B错）：个体进入病人角色后，由于某种原因又重新承担起本应免除的社会角色的责任，放弃了病人角色去承担其他角色的活动。角色行为缺如（C错）：病人未能进入病人角色，没有配合医疗活动恢复健康的想法与行为。虽然医师已做出疾病诊断，但病人尚未意识到自己已患病或不愿承认自己是病人。角色行为冲突（A错）：当多种社会地位和多种角色集于一人时，在其自身内部产生的冲突。个体在适应病人角色过程中，与其病前的各种角色发生心理冲突而引起行为的不协调。角色行为异常（D错）：这是病人角色适应中的一种特殊类型。病人无法承受患病或不治之症的挫折和压力，对病人角色感到厌倦、悲观、绝望，由此而导致行为异常。